属于超强效的外用糖皮质激素是
A. 氢化可的松
B. 地塞米松
C. 卤米松
D. 曲安奈德
E. 氟轻松

正确答案：C。卤米松

解析：本题考查糖皮质激素。属于超强效的外用糖皮质激素是卤米松（C对）。根据外用糖皮质激素的药理作用强度大致可分为弱效、中效、强效和超强效四类。弱效：醋酸氢化可的松（A错）。中效：醋酸地塞米松（B错）、丁酸氢化可的松、醋酸曲安奈德（D错）。强效：糠酸莫米松、二丙酸倍氯米松、氟轻松（E错）、0.025%哈西奈德。超强效：卤米松、0.1%哈西奈德、丙酸氯倍他索。